医师甲经执业医师注册，在某医疗机构执业。一年后，该医师受聘到另一医疗机构执业，其改变执业地点的行为
A. 医疗机构允许即可
B. 应到准予注册的卫生行政部门办理变更注册手续
C. 无须经过准予注册的卫生行政部门办理变更注册手续
D. 任何组织和个人无权干涉
E. 只要其医术高明，就不受限制

正确答案：B。应到准予注册的卫生行政部门办理变更注册手续

解析：《执业医师法》规定，取得医师资格的，可以向所在地县级以上人民政府卫生行政部门申请注册。医师变更执业地点、执业类别、执业范围等注册事项的，应当通过国家医师管理信息系统提交医师变更执业注册申请及省级以上卫生行政部门规定的其他材料。该医师经执业医师注册后在某医疗机构执医，一年后要去另一家医疗机构，改执业地点，他应到准予注册的卫生行政部门办理变更注册手续（B对）。